长期镉暴露对人体影响的主要靶器官是
A. 心
B. 大脑
C. 肾
D. 肝
E. 神经

正确答案：C。肾

解析：本题考查镉中毒的主要靶器官。慢性镉中毒是人群长期暴露于受镉污染的环境，主要是水体与土壤镉污染和由此导致的稻米与鱼贝类食物镉含量增高，造成摄入者体内镉蓄积并超过一定阈值所引起的以肾脏和骨骼损伤为主要中毒表现的环境污染性疾病。经消化道摄入是机体摄取镉的主要途径。吸收的镉进入血液后，部分与血红蛋白结合，部分与低分子硫蛋白结合，形成镉硫蛋白，通过血液循环到达全身，并有选择性地蓄积于肾、肝中。肾脏（C对ABDE错）可蓄积吸收量的1/3，是镉中毒的重要靶器官。